花粉粒类圆形或椭圆形，表面有网状雕纹，具1个萌发孔的药材是
A. 丁香
B. 洋金花
C. 西红花
D. 红花
E. 蒲黄

正确答案：E。蒲黄

解析：本题考查的是蒲黄的显微鉴别。花粉粒类圆形或椭圆形，表面有网状雕纹，具1个萌发孔的药材是蒲黄（E对）。蒲黄【显微鉴别】花粉粒黄色，呈类圆形或椭圆形，直径17～29㎛，表面有似网状雕纹，周边轮廓线光滑，呈凸波状或齿轮状，单萌发孔不甚明显。丁香（A错）【显微鉴别】粉末花粉粒众多，极面观三角形，赤道面观双凸镜形，具3副合沟。纤维梭形，顶端钝圆，壁较厚。草酸钙簇晶众多，直径4～26㎛，存在于较小的薄壁细胞中，常数个排列成行。油室多破碎，含油状物。洋金花（B错）【显微鉴别】粉末花粉粒类球形或长圆形，直径42～65㎛，表面有条纹状雕纹。花萼、花冠裂片边缘、花丝基部均具非腺毛。花萼、花冠薄壁细胞中有草酸钙砂晶、方晶及簇晶。西红花（C错）【显微鉴别】粉末：橙红色。表皮细胞表面观长条形，壁薄，微弯曲，有的外壁凸出呈乳头状或绒毛状，表面隐约可见纤细纹理。柱头顶端表皮细胞绒毛状，直径26～56㎛，表面有稀疏纹理。花粉粒较少，呈圆球形，红黄色，直径约10㎛，外壁近于光滑，内含颗粒状物质。草酸钙结晶聚集于薄壁细胞中，呈颗粒状、圆簇状、梭形或类方形。红花（D错）【显微鉴别】粉末花粉粒类圆球形或椭圆形，直径约至60㎛，外壁有刺或具齿状突起，具3个萌发孔。花冠、花丝、柱头碎片多见，有长管状分泌细胞，常位于导管旁，直径约66㎛，含黄棕色至红棕色分泌物。